下列关于受体与配体结合特点的选项中错误的是
A. 高度专一性
B. 高度亲和力
C. 可饱和性
D. 不可逆性
E. 非共价键结合

正确答案：D。不可逆性